利用电子显微镜观察原核生物和真核生物DNA复制过程，都能看到伸展成叉状的复制现象，其可能的原因是
A. DNA双链被解链酶解开
B. 拓扑酶发挥作用形成中间体
C. 有多个复制起始点
D. 冈崎片段连接时的中间体
E. 单向复制所致

正确答案：A。DNA双链被解链酶解开